呈棒状，上粗下细，表面黄白色，密被短柔毛的药材是
A. 菊花
B. 款冬花
C. 槐花
D. 金银花
E. 辛夷

正确答案：D。金银花

解析：本题考查的是金银花药材的性状鉴别。呈棒状，上粗下细，表面黄白色，密被短柔毛是金银花（D对）。金银花：【性状鉴别】药材呈棒状，上粗下细，略弯曲。表面黄白色或绿白色（贮久色渐深），密被短柔毛。偶见叶状苞片。花萼绿色，先端5裂，裂片有毛。开放者，花冠筒状，先端二唇形。气清香，味淡，微苦。菊花（A错）：【性状鉴别】药材亳菊呈倒圆锥形或圆筒形，有时稍压扁呈扇状。总苞碟状；总苞片卵形或椭圆形，草质，黄绿色或褐绿色，外面被柔毛，边缘膜质。花托半球形，无托片或托毛。舌状花数层，雌性，位于外围，类白色，劲直、上举，纵向折缩，散生金黄色腺点；管状花多数，两性，位于中央，为舌状花所隐藏，黄色，顶端5齿裂，瘦果不发育，无冠毛。体轻，质柔润，干时松脆。气清香，味甘、微苦。款冬花（B错）：【性状鉴别】药材呈长圆棒状。上端较粗，下端渐细或带有短梗，外面被有多数鱼鳞状苞片，习称“连三朵”。苞片外表面紫红色或淡红色，内表面密被白色絮状茸毛。体轻，撕开后可见白色茸毛。气清香，味微苦而辛。槐花（C错）：【性状鉴别】药材皱缩而卷曲，花瓣多散落。完整者花萼钟状，黄绿色，先端5浅裂，花瓣5，黄色或黄白色，近圆形，先端微凹。雄蕊10，其中9个基部连合，花丝细长。雌蕊圆柱形，弯曲。体轻。气微，味微苦。辛夷（E错）：【性状鉴别】药材望春花呈长卵形，似毛笔头。基部常具短梗，梗上有类白色点状皮孔。苞片外表面密被灰白色或灰绿色有光泽的长茸毛，内表面类棕色，无毛。体轻，质脆。气芳香，味辛凉而稍苦。